男，30岁。右下6金属全冠黏固1周后脱落，咬合时常有瞬间性疼痛。口腔检查见患者咬合紧，牙冠短，对颌牙面有银汞合金充填物，脱落的全冠完整。铸造金属全冠的修复体设计，可不考虑的因素是
A. 全冠的边缘位置
B. 全冠的面形态
C. 粘固剂的种类
D. 患者的年龄
E. 患者的性别

正确答案：E。患者的性别

解析：本题考查铸造金属全冠修复体设计。患者性别（E错，为本题正确答案）在临床上不会对铸造金属全冠修复产生影响，故不属于其考虑的因素。全冠的边缘位置（A对）不同在临床上会产生不同的影响，若设计在龈沟内，有利于防龋增进美观、加强固位；若设计龈上，既不损伤龈组织，也便于检查与修改修复体的边缘，减少或消除对龈组织的刺激，故铸造金属全冠的修复体设计应考虑全冠的边缘位置。全冠的面形态（B对）与应力有关，陡坡会增加牙冠的侧向力，影响牙冠固位力，属于铸造金属全冠考虑的因素。不同的粘接剂对固位力也会产生不同的的效果，故铸造金属全冠设计应考虑粘固剂的种类（C对）。在铸造金属全冠修复中，患者年龄（D对）越大，牙龈退缩，临床冠根比例变大，对边缘设计产生影响，故属于铸造金属全冠考虑的因素。